男，22岁，受凉后出现咽痛，咳嗽，发热，1天后出现全程肉眼血尿2次，无尿频，尿急，尿痛。尿常规：蛋白（++），尿沉渣镜检：RBC满视野。血SCr74μmol/L。最可能的疾病是
A. 急性间质性肾炎
B. 急性肾盂肾炎
C. 急进性肾小球肾炎
D. 急性肾小球肾炎
E. IgA肾病

正确答案：E。IgA肾病

解析：患者青年男性（IgA肾病好发人群），受凉后出现咽痛，咳嗽，发热（呼吸道前驱症状），1天后出现全程肉限血尿2次，无尿频，尿急，尿痛（排除炎症性疾病）。尿常规：蛋白（++）（正常不可见，提示蛋白尿），尿沉渣镜检：RBC满视野（血尿）。血SCr74μmol/L（男性正常值53～106μmol/L）。综合患者病史、症状及实验室检查，考虑诊断为IgA肾病（E对）。急性间质性肾炎（A错）会发生急性肾衰竭，同时伴有全身过敏表现。急性肾盂肾炎（B错）患者表现为寒战高热、腰痛，半数镜下可见镜下血尿，大量白细胞，尿蛋白定量为微量。急进性肾小球肾炎（C错）多数病人在发热或上呼吸道感染后出现急性肾炎综合征，即水肿、尿少、血尿、蛋白尿、高血压等。发病时患者全身症状较重，如疲乏、无力、精神萎靡，体重下降，可伴发热、腹痛。病情发展很快，起病数天内即出现少尿及进行性肾功能衰。急性肾小球肾炎（D错）患者表现为血尿蛋白尿、水肿、一过性高血压，约30%会出现肉眼血尿。